耳鸣耳聋，证属肾精亏损者，宜选用的中成药是
A. 葛根汤颗粒
B. 补中益气丸
C. 龙胆泻肝丸
D. 耳聋左慈丸
E. 导赤丸

正确答案：D。耳聋左慈丸

解析：本题考查的是耳鸣耳聋的辨证论治。耳鸣耳聋，证属肾精亏损者，宜选用的中成药是耳聋左慈丸（D对）。耳鸣，是指患者自觉耳内鸣响，如闻蝉声，或如潮声；耳聋，是指不同程度的听觉减退，甚至消失。耳鸣可伴有耳聋，耳聋亦可由耳鸣发展而来。西医的耳科病变（如中耳炎、鼓膜穿孔）、急性热性传染病（如猩红热、流行性感冒）、颅内病变（如脑肿瘤、听神经瘤）、药物中毒以及高血压、梅尼埃病、贫血、神经衰弱等疾病出现耳鸣耳聋症状均可参考此内容辨证论治。（一）风热侵袭证：【中成药应用】常用中成药有银翘散。（二）肝火上扰证：【中成药应用】常用中成药有龙胆泻肝丸（C错）（水丸）、通窍耳聋丸、泻青丸。（三）肾精亏损证：【中成药应用】常用中成药有耳聋左慈丸。（四）脾胃虚弱证：【中成药应用】常用中成药有补中益气丸（B错）。葛根汤颗粒（A错）为风寒感冒的中成药应用。风寒感冒：【中成药应用】常用中成药有荆防颗粒、感冒清热颗粒、感冒软胶囊、九味羌活丸、葛根汤颗粒。导赤丸（E错）为口疮心脾积热证的中成药应用。口疮心脾积热证：【中成药应用】常用中成药有牛黄清胃丸、导赤丸。